疾病预防控制机构、医疗机构和采供血机构及其执行职务的人员发现法律规定需报告的传染病疫情或者发现其他传染病暴发、流行以及突发原因不明的传染病时，应当按照国务院规定的或者国务院卫生行政部门规定的内容、程序、方式和时限报告，这种疾病监测方式属于
A. 哨点监测
B. 第二代监测
C. 主动监测
D. 被动监测
E. 行为学监测

正确答案：D。被动监测